与幽门螺旋杆菌感染相关性不确定的疾病是
A. 慢性胃炎
B. 消化性溃疡
C. 反流性食管炎
D. 胃黏膜相关淋巴组织淋巴瘤
E. 胃癌

正确答案：C。反流性食管炎

解析：反流性食管炎的主要病因是LES功能障碍，与幽门螺杆菌感染无关（C对）；慢性胃炎、消化性溃疡、胃癌、胃黏膜相关淋巴组织淋巴瘤均与幽门螺杆菌感染有相关性（ABDE错）。